患者臀部湿烂溃脓，伴恶寒发热，头痛骨楚，食欲不振，舌红苔黄，脉数。治法是
A. 清热利湿，活血化瘀
B. 清热解毒，和营化湿
C. 清热解毒，调补气血
D. 和营活血，利温化痰
E. 凉血清热，解毒通络

正确答案：B。清热解毒，和营化湿

解析：题干所述患者臀部湿烂溃脓，辨病为臀痈；根据“恶寒发热，头痛骨楚，食欲不振，舌红苔黄腻，脉数，辨证为湿火蕴结证。治则为清热解毒，和营化湿（B对），方选黄连解毒汤合仙方活命饮加减。